查体时鉴别腹股沟斜疝与直疝最有意义的是
A. 疝的外形
B. 透光试验
C. 疝内容物是否进入阴囊
D. 疝囊是否位于腹壁下动脉外侧
E. 回纳后压迫腹股沟深环，疝块是否能够复出

正确答案：E。回纳后压迫腹股沟深环，疝块是否能够复出

解析：腹股沟直疝和斜疝的根本区别在于两者的突出路径不同：直疝的疝囊直接经直疝三角由后向前突出；斜疝的疝囊经腹股沟管深环突出，斜行经过腹股沟管，再由腹股沟管浅环穿出，并可进入阴囊。因此，疝块回纳后压迫腹股沟管深环，斜疝的疝块不再突出，而直疝的疝块仍可突出。综上，查体时，鉴别腹股沟斜疝与直疝最有意义的是疝块回纳后压迫腹股沟管深环，疝块是否能够复出（E对）。疝的外形（A错）、疝内容是否进入阴囊（C错）、疝囊是否位于腹壁下动脉外侧（D错）可作为腹股沟斜疝和直疝的鉴别依据，但鉴别价值均不及E选项。透光试验（B错）对腹股沟疝和鞘膜积液的鉴别诊断有一定的帮助，对腹股沟斜疝和直疝的鉴别诊断意义不大。